蓼大青叶的化学成分主要有
A. 绿原酸
B. 齐墩果酸
C. 靛玉红
D. 靛蓝
E. 大黄素

正确答案：C、D。靛玉红；靛蓝

解析：本题考查的是蓼大青叶的成分。蓼大青叶的化学成分主要有靛玉红（C对）、靛蓝（D对）。蓼大青叶【成分】新鲜全草含靛青苷，酸水解后生成吲哚酚，在空气中被氧化成靛蓝。另含靛玉红、N-苯基-2-萘胺、β-谷甾醇等。金银花【成分】忍冬花蕾含黄酮类，为木犀草素及木犀草苷、忍冬苷、金丝桃苷。并含肌醇、绿原酸、异绿原酸、皂苷及挥发油。油中主含双花醇、芳樟醇等。现已证明金银花的抗菌有效成分以绿原酸（A错）和异绿原酸为主。党参【成分】党参根含三萜类化合物蒲公英萜醇、蒲公英萜醇乙酸酯、木栓酮、齐墩果酸（B错）等。大黄【成分】游离蒽醌衍生物有大黄酸、太黄素（E错）、大黄酚、芦荟大黄素、大黄素甲醚等，为大黄的抗菌成分。